分子中含有哌啶结构，具有μ受体活性作用的药物是
A. 吗啡
B. 曲马多
C. 盐酸美沙酮
D. 盐酸哌替啶
E. 盐酸纳洛酮

正确答案：D。盐酸哌替啶

解析：本题考查盐酸哌替啶。分子中含有哌啶结构，具有μ受体活性作用的药物是盐酸哌替啶（D对）。盐酸哌替啶属于哌啶类镇痛药，分子中含有哌啶结构，作用于μ受体，具有μ受体活性。吗啡（A错）是由5个环（A、B、C、D、E）稠合而成的复杂结构，含有部分氢化的菲环，有酚羟基和甲基叔胺基团。曲马多（B错）是其他合成镇痛药，是微弱的μ阿片受体激动剂。盐酸美沙酮（C错）为氨基酮类镇痛药物，分子中含有氨基酮结构。纳洛酮（E错）为阿片受体拮抗剂，分子中含有烯丙基结构，是将吗啡3位、6位羟基同时酯化，再将N-甲基用烯丙基取代得到的。